下列药物药用部位为干燥地上部分的是
A. 车前草
B. 青蒿
C. 茵陈
D. 香薷
E. 蒲公英

正确答案：B、C、D。青蒿；茵陈；香薷

解析：本题考查的是全草类中药的药用部位。下列药物药用部位为干燥地上部分的是青蒿（B对）、茵陈（C对）与香薷（D对）。药用部位为草本植物新鲜或干燥的全体或地上部分，这类中药称为全草类中药。有的药用部位为草本植物全体，如紫花地丁、蒲公英（E错）、金钱草、半枝莲、车前草（A错）等；有的药用部位为草本植物地上部分，如益母草、广金钱草、广藿香、薄荷、穿心莲、香薷、茵陈、青蒿、大蓟等；有的药用部位为草本植物肉质茎或带鳞叶的肉质茎，如锁阳、肉苁蓉等；有的药用部位为草本植物草质茎，如麻黄；有的药用部位为草本植物茎叶，如淡竹叶。